口腔颌面部常见的癌前病损有
A. 口腔红斑
B. 上皮过度角化
C. 口腔扁平苔藓
D. 盘状红斑狼疮
E. 口腔黏膜下纤维性变

正确答案：A。口腔红斑

解析：口腔颌面部最常见的癌前病损有白斑和红斑。红斑的癌变危险性比白斑尤甚，因而普遍地引起临床医务工作者的重视。临床上发现，80%的红斑患者病理切片证实为浸润癌或原位癌。癌前状态：口腔面颊部常见的癌前状态被认为有口腔扁平苔藓、口腔黏膜下纤维性变、盘状红斑狼疮、上皮过度角化、先天性角化不良以及梅毒、着色性干皮病等。掌握“口腔颌面部肿瘤的治疗原则及预防”知识点。